以下关于口腔颌面部损伤伤员急救的叙述中，哪项是错误的
A. 防止窒息的关键在于及早发现和及时处理
B. 对颅脑损伤的患者，在抢救的同时，颌面部伤口可做简单包扎处理
C. 病员如有脑脊液鼻漏或耳漏，应及时作鼻腔或耳道填塞
D. 有条件时应尽早进行清创缝合术
E. 无条件时应尽早包扎创口，防止外界细菌继续侵入

正确答案：C。病员如有脑脊液鼻漏或耳漏，应及时作鼻腔或耳道填塞

解析：如鼻孔或外耳道有脑脊液漏出，表明颅前窝底或颅中窝底有骨折。出血伴有脑脊液漏时，将流出的液体滴在吸水纸或纱布上，血迹周围出现一圈被水湿润的环形红晕，表明存在脑脊液漏。处理原则禁止作耳道与鼻腔填塞与冲洗，以减少引起颅内感染的可能。掌握“口腔颌面部创伤急救”知识点。